心的纤维支架是
A. 左、右纤维三角
B. 主动脉、肺动脉瓣环
C. 室间隔和瓣膜间隔
D. 圆锥韧带
E. 以上都是

正确答案：E。以上都是

解析：左、右纤维三角、肺动脉瓣环、主动脉瓣环、二尖瓣环、三尖瓣环、圆锥韧带、室间隔膜部和瓣膜间隔（ABCD对，故E为本题正确答案）构成心纤维性支架。